某男，50岁。数月来，症见虚劳咳嗽、骨蒸潮热、盗汗遗精、腰膝酸软。证属肺肾两亏，宜选用的成药是
A. 河车大造丸
B. 大补阴丸
C. 薯蓣丸
D. 玉泉丸
E. 左归丸

正确答案：A。河车大造丸

解析：本题考查的是河车大造丸的主治。某男，50岁。数月来，虚劳咳嗽、骨蒸潮热、盗汗遗精、腰膝酸软。证属肺肾两亏，宜选用的成药是河车大造丸（A对）。河车大造丸：【主治】肺肾两亏，虚劳咳嗽，骨蒸潮热，盗汗遗精，腰膝酸软。大补阴丸（B错）：【主治】阴虚火旺，潮热盗汗，咳嗽咯血，耳鸣遗精。薯蓣丸（C错）：【主治】气血两虚，脾肺不足所致的虚劳、胃脘痛、痹病、闭经、月经不调。玉泉丸（D错）：【主治】阴虚内热所致的消渴，症见多饮、多食、多尿；2型糖尿病见上述证候者。左归丸（E错）：【主治】真阴不足，腰酸膝软，盗汗遗精，神疲口燥。